需要在冷处贮藏的高警示药品是
A. 肾上腺素
B. 胰岛素
C. 降钙素
D. 高锰酸钾
E. 阿维A酸

正确答案：B。胰岛素

解析：本题考查胰岛素。需要在冷处贮藏的高警示药品是胰岛素（B对）。肾上腺素（A错）是高警示药品，但不需要在冷处贮藏，只要遮光，密闭，在阴凉处（不超过20℃）保存即可。降钙素（C错）不属于高警示药品，其贮于2～8℃。高锰酸钾（D错）属于高警示药品，但其不需要冷藏。阿维A酸（E错）是高警示药品，对育龄人群有生殖毒性，不需要冷藏。